在相同条件下，如果固定桥桥体的厚度减半，则其挠曲变形量变为
A. 增加至原来的2倍
B. 增加至原来的4倍
C. 增加至原来的6倍
D. 增加至原来的8倍
E. 增加至原来的27倍

正确答案：D。增加至原来的8倍

解析：相同条件下，桥体挠曲形变量与桥体的厚度的立方呈反比，与桥体长度的立方成正比。掌握“固定桥的设计”知识点。